可以与异丙嗪、哌替啶组成冬眠合剂用于人工冬眠的子宫平滑肌兴奋药是
A. 缩宫素
B. 垂体后叶素
C. 地诺前列腺素
D. 硫前列酮
E. 氢化麦角碱

正确答案：E。氢化麦角碱